羟基脲的抗肿瘤作用机制是
A. 抑制二氢叶酸还原酶
B. 阻止嘧啶核苷酸生成
C. 阻止嘌呤核苷酸生减
D. 抑制核苷酸还原酶
E. 抑制DNA多聚酶

正确答案：D。抑制核苷酸还原酶

解析：羟基脲能抑制核苷酸还原酶，阻止胞苷酸转变为脱氧胞苷酸，从而抑制DNA的合成。对S期有选择性杀伤作用，可使肿瘤细胞集中于G₁期，故可用作同步化药物，增加化疗或放疗的敏感性（D对）。